妇人腹痛肾阳虚衰证的治法是
A. 温肾助阳，暖宫止痛
B. 行气活血，化瘀止痛
C. 补血养营，和中止痛
D. 清热除湿，化瘀止痛
E. 散寒除湿，化瘀止痛

正确答案：A。温肾助阳，暖宫止痛

解析：妇人腹痛肾阳虚证治疗上一般会补肾助阳兼止痛（A对）。行气活血，化瘀止痛多用于治疗气滞血瘀的妇人腹痛证（B错）。补血养营，和中止痛多用于血虚，冲任失于濡养的妇人腹痛证（C错）。清热除湿，化瘀止痛多用于治疗湿热瘀结的妇人腹痛证（D错）。散寒除湿，化瘀止痛多用于寒湿凝滞，瘀阻胞宫的妇人腹痛证（E错）。